以下关于后堤区的描述，哪项是错误的
A. 后缘位于后颤动线之前
B. 前缘位于前颤动线
C. 后堤区平均宽8mm
D. 黏膜弹性较差
E. 后堤区有利于边缘封闭

正确答案：D。黏膜弹性较差

解析：后堤区：此区宽2～12mm，平均8.2mm。有一定的弹性，上颌全口义齿组织面与此区相应的部位可形成后堤，能起到边缘封闭作用。掌握“无牙颌的解剖标志及功能分区”知识点。